女，67岁，右手抖动，动作缓慢。考虑为帕金森病，体检时下列最不可能出现的体征是
A. 右上肢肌张力增高
B. 右上下肢反射亢进
C. 面部表情刻板
D. 行走时步距变小
E. 行走时右上肢连带动作消失

正确答案：B。右上下肢反射亢进